中国药典规定标准九号筛相当于工业筛
A. 50目
B. 80目
C. 100目
D. 120目
E. 200目

正确答案：E。200目